下列各项中，不属于急性心力衰竭中医证型的是
A. 气阴亏虚
B. 心肾阳虚
C. 气虚血瘀
D. 阳虚水泛
E. 痰瘀互结

正确答案：E。痰瘀互结

解析：急性心力衰竭以心阳虚衰为本，涉及各个脏腑，同时与气、阳、血、水关系密切，是本虚标实之证，属标本俱病，虚实夹杂（以本虚为主），故以气阴亏虚（A对）、心肾阳虚（B对）、气虚血瘀（C对）、阳虚水泛（D对）为常见中医证型。痰瘀互结（E错，为本题正确答案）属实证。